男，45岁。因反复咳嗽一个月到社区卫生服务中心就诊。医生与其交谈中得知该患者已经吸烟20多年，3年前曾经尝试戒烟一个月并得到家人的支持和鼓励。但后来患者由于听说戒烟会生病等传闻而不再考虑戒烟。家人对其的戒烟督促属于影响行为的
A. 倾向因素
B. 促成因素
C. 强化因素
D. 内在因素
E. 诱导因素

正确答案：C。强化因素

解析：该患者在戒烟过程中得到了家人的支持和鼓励，家人对其的戒烟督促属于影响行为的属于强化因素（C对）。倾向因素（A错）指为行为改变提供理由或动机的先行因素，在本题中应为该患者产生戒烟想法的最初原因。促成因素（B错）是指允许行为动机或愿望得以实现的先行因素，即实现或达到某种行为所需的技术和资源，在本题中应为该患者在戒烟过程中帮助患者执行戒烟行为的理论和医疗技术。在影响健康行为的因素中没有内在因素（D错）和诱导因素（E错）。